男，30岁。上腹痛7天，餐后突然加剧6小时，并很快波及全腹。既往有胃病史。当时查体：全腹压痛，反跳痛，肌紧张，肝浊音界消失，肠鸣音减弱。该病人进行手术治疗的主要目的是
A. 明确诊断
B. 去除病因
C. 清洗腹腔
D. 腹腔引流
E. 预防腹腔脓肿形成

正确答案：B。去除病因

解析：男性青年患者，上腹痛7天，餐后加剧6小时，并很快波及全腹（上腹痛，饱餐等诱因后转移为全腹痛）。既往有胃病史（考虑是否有胃十二指肠溃疡），当时查体：全腹压痛，反跳痛，肌紧张，肠鸣音减弱（考虑为由胃十二指肠穿孔所引起的急性腹膜炎），肝浊音界消失（考虑为胃十二指肠穿孔所引起的腹腔积气所致）。综合病人的病史、查体，入院后最可能的诊断为胃十二指肠溃疡穿孔。急性胃十二指肠溃疡穿孔以穿孔缝合术为主要术式，若采用彻底性的手术可以选择胃大部切除术，它可以一次性解决穿孔和溃疡两个问题。此两种术式均是针对疾病病因溃疡穿孔而言的术式，因此该病人进行手术治疗的主要目的是去除病因（B对）。明确诊断（A错）通过立位腹部平片等检查即可完成，并不需要手术治疗进行确诊。清洗腹腔（C错）、腹腔引流（D错）和预防腹腔脓肿形成（E错）均对于腹腔污染较严重者而言，只是手术的次要目的，并非主要目的。